清代的本草代表作是
A. 《新修本草》
B. 《本草纲目》
C. 《中华本草》
D. 《本草纲目拾遗》
E. 《经史证类备急本草》

正确答案：D。《本草纲目拾遗》

解析：本题考查的是历代本草著作。清代的本草代表作是《本草纲目拾遗》（（D对）。《本草纲目拾遗》：简称《纲目拾遗》，为清代本草代表作。作者赵学敏，定稿于1803年（清嘉庆八年）。《新修本草》（A错）：又称《唐本草》，为隋唐时期唐代的本草代表作。《本草纲目》（B错）：简称《纲目》，为明代本草代表作。作者李时珍。《中华本草》（C错）：为当代本草代表作。《经史证类备急本草》（E错）：简称《证类本草》，为宋金元时期宋代的本草代表作。作者唐慎微。